种子纽扣状圆板形表面被灰绿色绢装茸毛的药材是
A. 桃仁
B. 苦杏仁
C. 女贞子
D. 牵牛子
E. 马钱子

正确答案：E。马钱子

解析：本题考查的是马钱子药材的性状鉴别。种子纽扣状圆板形表面被灰绿色绢装茸毛的药材是马钱子（E对）。马钱子：【性状鉴别】药材呈纽扣状圆板形，常一面隆起，一面稍凹下。表面密被灰棕色或灰绿色绢状茸毛，自中间向四周呈辐射状排列，有丝样光泽。边缘稍隆起，较厚，有突起的珠孔，底面中心有突起的圆点状种脐。质坚硬，平行剖面可见淡黄白色胚乳，角质状，子叶心形。气微，味极苦。桃仁（A错）：【性状鉴别】药材呈扁长卵形。表面黄棕色至红棕色，密布颗粒状突起。一端尖，中部膨大，另端钝圆稍偏斜，边缘较薄。尖端一侧有短线形种脐，圆端有颜色略深不甚明显的合点，自合点处散出多数纵向维管束。种皮薄，子叶2，类白色，富油性。气微，味微苦。苦杏仁（B错）：【性状鉴别】药材呈扁心形。表面黄棕色至深棕色，一端尖，另端钝圆，肥厚，左右不对称，尖端一侧有短线形种脐，圆端合点处向上具多数深棕色的脉纹。种皮薄，子叶2，乳白色，富油性。气微，味苦女贞子（C错）：【性状鉴别】药材呈卵形、椭圆形或肾形。表面黑紫色或灰黑色，皱缩不平。基部有果梗痕或具宿萼及短梗。体轻。外果皮薄，中果皮较松软，易剥离，内果皮木质，黄棕色，具纵棱，破开后种子通常为1粒，肾形，紫黑色，油性。气微，味甘、微苦涩。牵牛子（D错）：【性状鉴别】药材似橘瓣状。表面灰黑色或淡黄白色，背面有1条浅纵沟，腹面棱线的下端有一点状种脐，微凹。质硬，横切面可见淡黄色或黄绿色皱缩折叠的子叶，微显油性。气微，味辛、苦，有麻感。加水浸泡后种皮呈龟裂状，手捻有明显的黏滑感。